男，34岁。近1个月来反复出现阵发性恐惧胸闷濒死感，多次到医院急诊就诊。心电图检查未见异常。为此担心苦恼，但仍能坚持工作，既往体健。该患者的主要表现是
A. 急性焦虑发作
B. 癔症发作
C. 癫痫发作
D. 广泛性发作
E. 心绞痛发作

正确答案：A。急性焦虑发作

解析：该男性患者近1个月来反复出现阵发性恐惧、胸闷、濒死感，持续时间半小时左右，为急性焦虑性发作（惊恐发作）的临床症状（A对）。癔症患者无惊恐发作的典型表现（恐惧、濒死感），也没有对再次发作的预期焦虑、恐惧（B错）。广泛性焦虑障碍（慢性焦虑）以焦虑为主要临床表现，患者没有明确对象的焦急、紧张和恐惧，而少有惊恐发作的典型表现（胸闷濒死感）（D错）。既往体健，血常规心电图及头颅CT等未见明显异常，故排除心绞痛（E错）。